股神经支配的肌群为
A. 大腿内收肌群
B. 大腿后肌群
C. 大腿前肌群
D. 髋肌
E. 小腿前外侧肌群

正确答案：C。大腿前肌群

解析：大腿内收肌群（A错）由闭孔神经支配。大腿后肌群（B错）由坐骨神经支配。大腿前肌群（C对）由股神经支配。髋肌（D错）由腰丛分支支配。小腿前外侧肌群（E错）由腓总神经支配。